气摄血功能失常可见
A. 气虚血少
B. 气虚血瘀
C. 气虚出血
D. 气虚血脱
E. 血虚气亏

正确答案：C。气虚出血

解析：气能摄血，指气能控制血液在脉中正常运行而不逸出脉外。若脾气虚弱，失去统摄，血逸出脉外，可出现气不摄血，气虚出血（C对）的表现。重者，可出现气虚血脱。由于单选题，选择最佳选项，所以正确答案为C。气虚血少（A错）由于气能生血功能失常所致。气虚血瘀（B错）由于气行血功能异常所致。气虚血脱（D错）由于气的摄血功能严重异常所致。血虚气亏（E错）是血能养气功能异常。